化学毒物在胃肠道吸收的主要方式为
A. 简单扩散
B. 主动转运
C. 易化扩散
D. 胞吞

正确答案：A。简单扩散

解析：本题考查化学毒物在胃肠道吸收的主要方式。化学毒物在胃肠道吸收的主要方式为简单扩散（A对BCD错），简单扩散是大多数化学毒物通过生物膜的方式。该转运方式不消耗能量，不需要载体，不受饱和限速与竞争性抑制的影响。